胺碘酮的作用是
A. 延长APD，阻滞Na⁺内流
B. 缩短APD，阻滞Na⁺内流
C. 延长ERP，促进K⁺外流
D. 缩短APD，阻断β受体
E. 缩短ERP，阻断α受体

正确答案：A。延长APD，阻滞Na⁺内流

解析：胺碘酮的作用属于Ⅲ类延长动作电位时程的药物，是广泛的抗心律失常药，阻滞钾通道，抑制钾离子外流（C错），明显延长APD及ERP（BDE错）；阻滞钠通道，阻滞Na⁺内流（A对）具有第Ⅰ类抗心律失常药的作用，以及Ⅳ类抗心律失常药阻滞钙通道的特性。该药还具有非竞争性地阻断α、β受体，扩张冠状动脉，降低外周血管阻力，保护缺血心肌等作用。